影响药物作用的主要因素有
A. 量效关系
B. 药品价格
C. 药品包装
D. 给药途径
E. 个体差异

正确答案：A、D、E。量效关系；给药途径；个体差异

解析：本题考查影响药物作用的因素。影响药物作用的因素：1.机体方面的因素：年龄、性别、病理状态、个体差异（E对）和遗传因素、种属差异等。2.药物方面的影响：剂型、剂量（A对）、给药途径（D对）、给药时间、反复用药、药物相互作用等。药品价格（B错）和药品包装（C错）不是影响药物作用的因素。